常用的油脂性栓剂基质有
A. 可可豆脂
B. 椰油酯
C. 山苍子油酯
D. 甘油明胶
E. 聚氧乙烯（40）单硬脂酸酯类

正确答案：A、B、C。可可豆脂；椰油酯；山苍子油酯

解析：本题考查栓剂的基质。可可豆脂（A对）、椰油酯（B对）、山苍子油酯（C对）为常用的油脂性栓剂基质；甘油明胶（D错）为水溶性基质；聚氧乙烯（40）单硬脂酸酯类（E错）为乳化剂。